下列哪项，属生理性胎黄
A. 生后24h内出现
B. 黄疸10-14天左右消退
C. 黄疸退而复现
D. 黄疸持续加深
E. 早产儿黄疸消退早

正确答案：B。黄疸10-14天左右消退

解析：胎黄以婴儿出生后皮肤面目出现黄疸为特征。足月儿大多在生后第2～3天出现黄疸，早产儿黄疸多于生后3～5天出现（A错）。足月儿黄疸在5～7天消退，最迟不超过两周（B对）；早产儿黄疸在7～9天消退，最长可延迟到3～4周（E错）。病理性黄疸出现早，在出生后24小时内，发展快，程度重，消退迟或黄疸退而复现（CD错）。